《药品生产监督管理办法（暂行）》规定，药品生产企业不得申请委托生产的药品包括
A. 天然药物提取物
B. 中药饮片
C. 各类注射剂
D. 血液制品、疫苗制品
E. 中成药制剂

正确答案：D。血液制品、疫苗制品

解析：本题考查不得申请委托生产的药品。药品生产企业不得申请委托生产的药品包括：麻醉药品、精神药品、药品类易制毒化学品及其复方制剂，医疗用毒性药品，生物制品，多组分生化药品，中药注射剂和原料药。血液制品、疫苗（D对）都属于生物制品，故不得申请委托生产。